急性大失血患者，无同型血源，分别与A型、B型血作交叉配血，其结果为主侧均无凝集，次侧均有凝集，此患者的血型是
A. A型
B. B型
C. AB型
D. O型
E. Rh阳性

正确答案：C。AB型

解析：交叉配血是将献血人的红细胞和血清分别与受血人的血清和红细胞混合，观察有无凝集反应，若两侧均不凝集方可输血。本例患者因需输血而分别与A型、B型血做交叉配血试验，试验结果为主侧均无凝集，次侧均有凝集，故此患者的血型为AB型（C对）。A型（A错）血者与A型血做交叉配血试验的结果为主侧与次侧均无凝集，与B型血做交叉配血试验的结果为主侧与次侧均有凝集。B型（B错）血者与A型血做交叉配血试验的结果为主侧与次侧均有凝集，与B型血做交叉配血试验的结果为主侧与次侧均无凝集。O型（D错）血者与A型血、B型血做交叉配血试验的结果为主侧均有凝集，次侧均无凝集。Rh阳性（E错）不属于ABO血型系统，Rh阳性者与A型、B型血做交叉配血试验的结果与其ABO血型有关。